某中学要设立一心理咨询室。对于求咨者和咨询者位置关系的设立，你认为存在错误的是
A. 心理咨询的位置关系以面对面坐法最常见
B. 面对面的坐法可能会加重初次求咨者的心理负担
C. 并排坐可减少求咨者的紧张不安，但这场景常是关系亲密的象征，对内向、拘谨或异性青少年应该避免
D. 较理想的位置关系是求咨者坐在咨询者的右侧位置
E. 求咨者和咨询者之间宜放置一小桌

正确答案：D。较理想的位置关系是求咨者坐在咨询者的右侧位置